关于宣威肺癌的流行特征说法错误的是
A. 性别差异不明显
B. 女性肺癌死亡率高
C. 宣威地区周围区域发病最严重
D. 室内空气污染状况较为严重
E. 男、女性死亡率高峰年龄组均出现在“55～”年龄组

正确答案：C。宣威地区周围区域发病最严重

解析：本题考查宣威肺癌的流行特征。宣威肺癌的流行特征有：男女性别差异不明显（A对）；女性肺癌死亡率高于男性（B对）；宣威高发区域发病最严重（C错，为本题正确答案）；室内空气污染状况较为严重（D对）；男、女性死亡率高峰年龄组均出现在“55～”年龄组（E对）。